朗格汉斯细胞属于
A. 透明细胞
B. 角质细胞
C. 基底层
D. 中间层
E. 棘层

正确答案：A。透明细胞

解析：本题考查朗格汉斯细胞。朗格汉斯细胞属于透明细胞（A对）。朗格汉斯细胞（LC）在HE染色切片中，这种细胞虽然也表现为透明细胞，但是位于表皮中上部，不像黑素细胞常位于基底层内。角质细胞（B错）：为口腔黏膜复层鳞状上皮的主要构成细胞，该细胞由深层至表面依次是基底层（C错）、棘层（E错）、颗粒层、角化层。中间层（D错）：为非角化上皮的构成结构。